根据ISFC/WHO对缺血性心脏病的分类初发劳累性心绞痛是
A. 劳累性心绞痛病程在1个月以内
B. 劳累性心绞痛临床特点1个月以上无变化
C. 同等程度劳累所诱发的胸痛发作次数增加、严重程度加重及持续时间延长
D. 劳累性心绞痛病程在3个月以内
E. 劳累性心绞痛临床特点3个月以上无变化

正确答案：A。劳累性心绞痛病程在1个月以内

解析：初发型心绞痛通常在首发症状1～2个月内（A对DE错）、很轻的体力活动可诱发（程度至少达CCSⅢ级）。劳累性心绞痛临床特点1个月以上无变化（B错）为稳定型劳力性心绞痛的特点。同等程度劳累所诱发的胸痛发作次数增加严重程度加重及持续时间延长（C错）为恶化型心绞痛的特点。